在两样本比较的秩和检验中，已知第1组的样本量为n₁=10，秩和T₁=136，第2组的样本量为n₂=15，秩和T₂=189，若双侧0.05的T界值范围为94～166，按a=0.05，作出的统计推断是
A. 94＜T₂，P＜0.05，拒绝H₀
B. T₂＞166，P＜0.05，拒绝H₀
C. T₁＜166，P＞0.05，不拒绝H₀
D. 94＜T₁，P＜0.05，拒绝H₀
E. 94＜T₁＜166，P＞0.05，不拒绝H₀

正确答案：E。94＜T₁＜166，P＞0.05，不拒绝H₀